某女，30岁。患急性扁桃体炎2天。颌下咽部红肿、咽痛，伴发热、微恶脉浮数。证属外感风热，宜选用的成药是
A. 六神丸
B. 清音丸
C. 栀子金花丸
D. 牛黄解毒丸
E. 复方鱼腥草片

正确答案：E。复方鱼腥草片

解析：本题考查的是复方鱼腥草片的主治。患急性扁桃体炎2天。颌下咽部红肿、咽痛，伴发热、微恶脉浮数。证属外感风热，宜选用的成药是复方鱼腥草片（E对）。复方鱼腥草片：【主治】外感风热所致的急喉痹、急乳蛾，症见咽部红肿、咽痛；急性咽炎、急性扁桃体炎见上述证候者。六神丸（A错）：【主治】烂喉丹痧，咽喉肿痛，喉风喉痈，单双乳蛾，小儿热疖，痈疡疔疮，乳痈发背，无名肿毒。清音丸（B错）：【主治】肺热津亏，咽喉不利，口舌干燥，声哑失音。栀子金花丸（C错）：【主治】肺胃热盛所致的口舌生疮、牙龈肿痛、目赤眩晕、咽喉肿痛、吐血衄血、大便秘结。牛黄解毒片（D错）：【主治】火热内盛所致的咽喉肿痛、牙龈肿痛、口舌生疮、目赤肿痛。